诊断甲亢（Graves病）最有价值的体征是
A. 皮肤湿润、多汗、手颤
B. 阵发性心房纤颤
C. 甲状腺肿大伴震颤和血管杂音
D. 收缩压升高，舒张压降低，脉压增大
E. 窦性心动过速

正确答案：C。甲状腺肿大伴震颤和血管杂音

解析：Graves病即弥漫性毒性甲状腺肿，甲状腺呈弥漫性对称性肿大，左右叶上、下极可触及震颤伴血管杂音（C对），为本病最有价值的体征。甲亢时，由于机体高代谢，产热增多，常有皮肤潮湿多汗，由于神经系统兴奋，可具有手颤、眼震（A错）；由于心血管功能亢进，可伴有窦性心动过速（E错）、收缩压升高、舒张压降低、脉压增大（D错）；若合并甲亢性心脏病，则可有心律失常，以心房颤动（B错）最常见，以上均可见于各种病因导致的甲亢（P680），无特异性。